地西泮抗焦虑的主要作用部位是
A. 边缘系统
B. 大脑皮质
C. 黑质纹状体
D. 下丘脑
E. 脑干网状结构

正确答案：A。边缘系统